男，7个月，出生时唇部裂开，查体见左侧红唇至鼻底裂开，右侧裂隙未至鼻底。根据以上资料，可诊断为
A. 左侧不全唇裂，右侧完全唇裂
B. 双侧不全唇裂
C. 左Ⅱ度唇裂，右Ⅲ度唇裂
D. 左Ⅲ度唇裂，右Ⅰ度唇裂
E. 左侧完全唇裂，右侧不全唇裂

正确答案：E。左侧完全唇裂，右侧不全唇裂

解析：本题考查唇裂的国际分类。单侧唇裂分为：单侧不完全性唇裂（裂隙未裂至鼻底），单侧完全性唇裂（整个上唇至鼻底完全裂开）。双侧唇裂分为：双侧不完全性唇裂（双侧裂隙均未裂至鼻底），双侧完全性唇裂（双侧上唇至鼻底完全裂开），双侧混合性唇裂（一侧完全裂，另一侧不完全裂）。此患者左侧红唇至鼻底裂开，右侧裂隙未至鼻底可诊断为双侧混合性唇裂即左侧完全唇裂，右侧不全唇裂（E对）。